抢救脑型中毒型细菌性痢疾，首选的治疗措施是
A. 应用血管活性药物
B. 降低颅内压，利尿
C. 应用抗凝药物
D. 应用糖皮质激素
E. 应用抗生素

正确答案：B。降低颅内压，利尿

解析：脑型中毒型细菌性痢疾，因脑缺氧、水肿而发生反复惊厥、昏迷和呼吸衰竭。早期可有嗜睡、呕吐、头痛、血压偏高，心率相对缓慢。随病情进展，很快进入昏迷、频繁或持续惊厥阶段。瞳孔大小不等、对光反射消失，呼吸深浅不匀、节律不整，甚至呼吸停止。此型较严重，病死率高。必须把防治脑水肿和呼吸衰竭放在首位，即积极降低颅内压，或与利尿剂交替使用（B对），以降低死亡率。可短期推注地塞米松（D错），但并不是首选治疗。应用血管活性药物（A错）和应用抗凝药物（C错）属针对感染性休克的治疗，应用抗生素（E错）属抗菌治疗，均不是首选的治疗措施。